药用部位为干燥菌核的药材是
A. 冬虫夏草
B. 茯苓
C. 海藻
D. 灵芝
E. 松萝

正确答案：B。茯苓

解析：本题考查的茯苓的来源。药用部位为干燥菌核的药材是茯苓（B对）。茯苓：【来源】为多孔菌科真菌茯苓的干燥菌核。冬虫夏草（A错）：【来源】为麦角菌科真菌冬虫夏草寄生在蝙蝠蛾科昆虫幼虫上的子座及幼虫尸体的干燥复合体。海藻（C错）：【来源】为马尾藻科植物海蒿子或羊栖菜的干燥藻体。前者习称“大叶海藻”，后者习称“小叶海藻”。灵芝（D错）：【来源】为多孔菌科真菌赤芝或紫芝的干燥子实体。松萝（E错）为地衣类中药，药用部位为地衣体。